减少冷冻动物性食物营养损失的重要措施是
A. 快速冷冻，缓慢融化
B. 缓慢冷冻，快速融化
C. 长时间冷冻
D. 超低温冷冻，快速融化
E. 缓慢冷冻，缓慢融化

正确答案：A。快速冷冻，缓慢融化

解析：本题考查减少冷冻动物性食物营养损失的重要措施。快速冷冻，缓慢融化（A对BCDE错）是减少冷冻动物性食物营养损失的重要措施。